相当于121℃热压灭菌时，杀灭物品中全部微生物所需时间的参数是
A. D值
B. Z值
C. F₀值
D. F值
E. HLB值

正确答案：C。F₀值

解析：本题考查的是灭菌参数。相当于121℃热压灭菌时，杀灭物品中全部微生物所需时间的参数是F₀值（C对）。F0值：在一定灭菌温度（T）Z值为10℃所产生的灭菌效果与121℃、Z值为10℃产生的灭菌效果相同时所相当的时间（min）。D值（A错）：（考察对时间的关系）在一定温度下，杀灭90%微生物所需的灭菌时间。Z值（B错）：（考察对温度的敏感性）降低一个lgD值所需升高的温度，即灭菌时间减少到原来的1/10所需升高的温度或相同灭菌时间内，杀灭99%的微生物所需提高的温度。F值（D错）：在一定灭菌温度（T）下给定的Z值所产生的灭菌效果与在参比温度（T0）下给定的Z值所产生的灭菌效果相同时所相当的时间。HLB值（E错）：表面活性剂为具有亲水基团和亲油基团的两亲分子，表面活性剂分子中亲水基和亲油基之间的大小和力量平衡程度的量，定义为表面活性剂的亲水亲油平衡值。